表面棕红色或灰黑色，常附有少量棕红色粉末，具“钉头”的中药材是
A. 芒硝
B. 滑石
C. 炉甘石
D. 自然铜
E. 赭石

正确答案：E。赭石

解析：本题考查的是赭石药材的性状鉴别。表面棕红色或灰黑色，常附有少量棕红色粉末，具“钉头”的中药材是赭石（E对）。赭石：【性状鉴别】药材为鲕状、豆状、肾状集合体。多呈不规则的扁平块状。暗棕红色或灰黑色，条痕樱红色或红棕色，有的有金属光泽。一面多有圆形的突起，习称“钉头”；另一面与突起相对应处有同样大小的凹窝。体重，质硬，砸碎后断面显层叠状。气微，味淡。芒硝（A错）：【性状鉴别】药材为棱柱状、长方形或不规则块状及粒状。无色透明或类白色半透明。质脆，易碎，断面呈玻璃样光泽。气微，味咸。滑石（B错）：【性状鉴别】药材多为块状集合体。呈不规则块状。白色、黄白色或淡蓝灰色，有蜡样光泽。质软，细腻，手摸有滑润感，无吸湿性，置水中不崩散。气微，味淡。炉甘石（C错）：【性状鉴别】药材为块状集合体，呈不规则块状。灰白色或淡红色，表面粉性，无光泽，凹凸不平，多孔，似蜂窝状。体轻，易碎。气微，味微涩。自然铜（D错）：【性状鉴别】药材晶型多为立方体，集合体呈致密块状。表面亮淡黄色，有金属光泽；有的黄棕色或棕褐色，无金属光泽。具条纹，条痕绿黑色或棕红色。体重，质坚硬或稍脆，易砸碎，断面黄白色，有金属光泽；或断面棕褐色，可见银白色亮星。